女，35岁。停经4个月，腹痛1天。有子宫肌瘤病史。妇科检查：子宫左侧壁可触及结节状突起，压痛明显。血WBC12.3×10⁹/L。B超提示：中期妊娠，子宫肌瘤。该患者肌瘤变性最可能是
A. 玻璃样变
B. 红色样变
C. 钙化
D. 囊性变
E. 肉瘤样变

正确答案：B。红色样变

解析：患者青年女性，停经4个月伴腹痛1天，既往有子宫肌瘤病史，妇检可触及子宫左侧壁结节状突起，伴压痛（肌瘤红色样变时有急性下腹痛、伴呕吐、发热及肿瘤局部压痛），白细胞稍高（（正常值4.0～10.0×10⁹/L），B超提示中期妊娠，子宫肌瘤。妊娠期间容易发生的肌瘤变性是红色样变（B对），玻璃样变（A错）是最常见的变性，继续发展可变成囊样变（D错）。钙化（C错）多见于蒂部细小、血供不足的浆膜下肌瘤以及绝经后妇女的肌瘤。肉瘤样变（E错）多见于绝经后伴疼痛的出血的患者（P311）。